任何特定的行为问题都是
A. 受三类因素（倾向因素、促成因素、强化因素）共同作用的
B. 互相独立、互不相干
C. 互相矛盾的
D. 互相制约的
E. 主要由倾向因素决定

正确答案：A。受三类因素（倾向因素、促成因素、强化因素）共同作用的